平滑面龋所呈现的“三角形”中，能够表示病变最早、最活跃的部分是
A. 三角形基底部
B. 三角形中部
C. 釉质表面
D. 釉牙本质界
E. 不能代表龋病进展

正确答案：D。釉牙本质界

解析：平滑面龋病的病理表现中的“三角形”病损，其顶部为病变最早、最活跃的部分。掌握“牙釉质龋”知识点。